肝左、中、右静脉出肝的部位
A. 肝圆韧带
B. 静脉韧带
C. 第2肝门
D. 肝总管
E. 胆总管

正确答案：C。第2肝门

解析：第2肝门(C对)为肝左、中、右静脉出肝的部位。